女，65岁。持续性上腹痛1天。查体：T38.4°C。巩膜无黄染。心肺无异常。上腹部压痛。肠鸣音减退。实验室检查：Hb120g/L，WBC15.4×10⁹/L，PLT154×10⁹/L；血淀粉酶860U/L，LDH456U/L。腹部B超：胆总管内径0.6cm，末端及胰腺因气体干扰显示不清。对患者的诊断及指导治疗最有意义的辅助检查是
A. 腹部X线平片
B. 腹部增强CT
C. 心电图
D. 经内镜逆行胆胰管造影
E. 超声心动图

正确答案：B。腹部增强CT

解析：患者持续性上腹痛，血淀粉酶高（正常35-135U/L），肠鸣音减退，LDH高（正常100-300U/L），考虑诊断为急性胰腺炎。对患者的诊断及指导治疗最有意义的辅助检查是腹部增强CT（B对）。不仅能诊断急性胰腺炎，而且能鉴别是否合并胰腺组织坏死。在胰腺弥漫性肿大的基础上出现质地不均、液化和蜂窝状低密度区，则可诊断为胰腺坏死。